尘肺中危害最严重的的是
A. 煤尘肺
B. 硅酸盐肺
C. 矽肺
D. 金属尘肺
E. 石棉肺

正确答案：C。矽肺

解析：本题考查尘肺的种类。尘肺称为肺尘埃沉着病，包括矽肺（C对ABDE错）、硅酸盐肺、炭尘肺、混合性尘肺和金属尘肺。其中，矽肺是尘肺中危害最严重的一种。